常见于过敏体质病人
A. 副作用
B. 毒性反应
C. 后遗效应
D. 停药反应
E. 变态反应

正确答案：E。变态反应

解析：变态反应是一类免疫反应，也称过敏反应，常见于过敏体质病人。反应性质与药物原有效应无关，用药理性拮抗药解救无效。掌握“药物不良反应”知识点。